我国的《公共交通等候室卫生标准》对以下项目提出了卫生要求，除了
A. 小气候
B. 照度
C. 噪声
D. 空气质量
E. 新风量

正确答案：E。新风量

解析：本题考查《公共交通等候室卫生标准》。我国的《公共交通等候室卫生标准》对小气候（A对）、照度（B对）、噪声（C对）、空气质量（D对）等项目提出了卫生要求，除了新风量（E错，为本题正确答案）。